发热不伴有寒战的是
A. 败血症
B. 大叶性肺炎
C. 急性肾盂肾炎
D. 伤寒
E. 重症肺结核

正确答案：D。伤寒

解析：人体在发热的同时常伴有一些伴随症状及体征，这些伴随症状和体征对发热的病因诊断具有重要的意义。如伤寒（D错，为本题正确答案）时，有持续性高热（40～41℃）1～2周以上，并出现特殊中毒面容，如相对缓脉，皮肤玫瑰疹，肝脾肿大，表现为发热不伴有寒战。发热伴寒战的情况，常见于肺炎链球菌肺炎（B对）、败血症（A对）、急性肾盂肾炎（C对）、急性胆囊炎、流行性脑脊髓膜炎、疟疾、药物热、急性溶血或输血反应、重症肺结核（E对）等。